患者小便黄赤灼热，尿血鲜红，心烦口渴，面赤口疮，夜寐不安，舌红，脉数。其治法是
A. 清肝凉血，化瘀止血
B. 清利湿热，凉血止血
C. 清热泻火，凉血止血
D. 清心泻火，宁络止血
E. 清热生津，宁络止血

正确答案：B。清利湿热，凉血止血

解析：根据“尿血鲜红”可知病为“血证”；根据“小便黄赤灼热，尿血鲜红，心烦口渴，面赤口疮，夜寐不安，舌红，脉数”辨为“下焦湿热证”；其机理为下焦湿热蕴结，热伤阴络，血渗膀胱，治疗应以清热利湿、凉血止血为法（B对）。